血红蛋白含量最常以
A. 算术均数
B. 中位数
C. 几何均数
D. 标准差
E. 百分位数

正确答案：A。算术均数

解析：算术均数：简称均数，它是一组变量值之和除以变量值个数所得的商。适用于呈正态或近似正态分布的定量资料。大多数正常生物的生理、生化指标都宜用均数表达其集中趋势。掌握“定量资料的统计描述和推断”知识点。